患儿，7岁。昨轻微发热恶寒，随即左侧耳下腮部漫肿疼痛，咀嚼不便，咽红，舌质红，舌苔薄白，脉浮数。其治法是
A. 疏风清热，散结消肿
B. 疏风清热，活血化瘀
C. 清热解毒，软坚散结
D. 清热解毒，熄风开窍
E. 清肝泻火，活血止痛

正确答案：A。疏风清热，散结消肿

解析：该题主要考查小儿流行性腮腺炎的辩证以及治法。流行性腮腺炎是由腮腺炎时邪(腮腺炎病毒)引起的一种急性传染病，以发热、耳下腮部肿胀疼痛为主要特征。邪犯少阳证以轻微发热、耳下腮部漫肿疼痛、咀嚼不便为特征，全身症状不重。该患儿，7岁。该患者昨轻微发热恶寒，随即左侧耳下腮部漫肿疼痛，咀嚼不便，咽红，舌质红，舌苔薄白，脉浮数。可判断为流行性腮腺炎邪犯少阳证候，治法疏风清热，散结消肿（A对）。流行性腮腺炎中无疏风清热，活血化瘀治法（B错）。清热解毒，软坚散结为流行性腮腺炎热毒壅盛治法，证候 高热，一侧或两侧耳下腮部肿胀疼痛，坚硬拒按，张口咀嚼困难，或有烦躁不安，口渴欲饮，头痛，咽红肿痛，领下肿块胀痛，纳少，大便秘结，尿少而黄，舌质红，舌苔黄，脉滑数（C错）。清热解毒，熄风开窍为流行性腮腺炎邪陷心肝治法，证候高热，耳下腮部肿痛，坚硬拒按，神昏，嗜睡，项强，反复抽搐，头痛，呕吐，舌红，苔黄，脉弦数（D错）。清肝泻火，活血止痛为流行性腮腺炎毒窜睾腹治法，证候腮部肿胀消退后，一侧或双侧皋丸肿胀疼痛，或院腹、少腹疼痛，痛时拒按，舌红，苔黄，脉数（E错）。